女性患者，23岁，因右上颌第一恒磨牙严重根尖周炎症需要拔除。但是在曲面断层全景片检查后医生发现，此患者的右上第二前磨牙阻生，造成此种情况的原因是
A. 右上第一恒磨牙早萌
B. 右上第二恒磨牙早萌
C. 右上第一乳磨牙早失
D. 右上第二乳磨牙早失
E. 右上第一乳磨牙早萌

正确答案：D。右上第二乳磨牙早失

解析：若第二乳磨牙在第一恒磨牙萌出之前早失，第一恒磨牙在萌出之前就已经近中移动使第二前磨牙阻生。若第二乳磨牙在第一恒磨牙萌出之后早失，第一恒磨牙也会向近中移动使第二前磨牙阻生。掌握“乳牙早失及间隙管理”知识点。